男，18岁。反复左侧腰部胀痛3年余。B超见左肾重度积水，左输尿管显示不清。总肾功能正常，尿常规：RBC（-），WBC5～10/HP。IVU检查示左肾显影不清晰，右肾正常。为明确病变的部位，最常用的检查方法是
A. KUB
B. 放射性核素肾显像
C. B超
D. 逆行肾盂造影
E. CT平扫

正确答案：D。逆行肾盂造影

解析：青年男性患者，左侧腰部胀痛，B超见左肾重度积水，IVU检查示左肾显影不清晰，右肾正常，结合患者病史、临床表现和相关检查，应考虑左肾结核。为明确病变部位，最常用的检查方法是静脉尿路造影（IVU）或逆行肾盂造影，患者行IVU检查示左肾显影不清晰，故应行逆行肾盂造影（D对）。逆行肾盂造影可以清楚显示病变部位，如病肾空洞性破坏、输尿管僵硬、管腔节段性狭窄且边缘不整等。KUB（尿路平片）（A错）可显示病肾的钙化灶，但对于轻度病灶显影不佳。放射性核素肾显像（B错）能显示肾形态、大小及有无占位性病变，但对于肾结核病灶的显影效果较差。患者已行B超检查，再次检查对诊断价值不大（C错）。CT平扫（E错）对中晚期肾结核能清楚显示扩大的肾盏肾盂、皮质空洞及钙化灶，但其效果没有逆行肾盂造影好。